以下检验属于非参数检验的是
A. 卡方检验
B. t检验
C. 秩和检验
D. z检验
E. P检验

正确答案：C。秩和检验

解析：秩和检验属于非参数检验。掌握“秩和检验、直线回归和线性分析”知识点。